人的心理现象包括既有区别又有密切联系的两个方面是
A. 认识过程和人格
B. 心理过程和情感过程
C. 心理过程和人格
D. 认识过程和意志过程
E. 情感过程和意志过程

正确答案：C。心理过程和人格

解析：一般把心理现象分为心理过程和人格(或个性)。掌握“人格”知识点。